以下哪种原因不是引起感染性休克的常见病因
A. 挤压伤
B. 绞窄性肠梗阻
C. 急性弥漫性腹膜炎
D. 胆道感染
E. 大面积烧伤

正确答案：A。挤压伤

解析：本题考查休克。感染性休克常见于胆道感染（D对）、绞窄性肠梗阻（B对）、大面积烧伤（E对）、急性弥漫性腹膜炎（C对）、脓毒症，是以释放内毒素的革兰阴性杆菌为主的感染。而挤压伤（A错，为本题正确答案）属于创伤性休克的常见病因。